反复使用吗啡会产生
A. 生理依赖性
B. 首剂现象
C. 耐药性
D. 耐受性
E. 致敏性

正确答案：A、D。生理依赖性；耐受性

解析：本题考查阿片类镇痛药吗啡的不良反应。长期反复使用吗啡会产生生理依赖性（A对）和耐受性（D对）。首剂现象（B错）是病人在初服某种药物时，由于机体对药物作用尚未适应而引起不可耐受的强烈反应。耐药性（C错）是指微生物、寄生虫以及肿瘤细胞等等,对药物治疗的反应比较差。致敏性（E错）是某药品中含有使部分过敏人群发生过敏的物质。